铁的最好食物来源是
A. 肉类
B. 谷类
C. 蛋类
D. 牡蛎
E. 豆类

正确答案：A。肉类